小儿呼吸道感染服用琥乙红霉素颗粒，剂量为30～50mg/（kg·d），分3～4次服用，则体重为20kg的儿童一次剂量为
A. 175～250mg或125～225mg
B. 200～333mg或150～250mg
C. 215～350mg或175～270mg
D. 225～375mg或200～300mg
E. 250～375mg或225～325mg

正确答案：B。200～333mg或150～250mg

解析：本题考查给药剂量的计算。若每日分3次服用，按最小剂量30mg/kg计算，则一次给药剂量=30mg/kg×20kg÷3=200mg；按最大剂量50mg/kg计算，则一次给药剂量=50mg/kg×20kg÷3≈333mg。若每日分4次服用，按最小剂量30mg/kg计算，则一次给药剂量=30mg/kg×20÷4=150mg，按每日最大剂量50mg/kg计算，则一次给药剂量=50mg/kg×20kg÷4=250mg。因此，体重为20kg的儿童一次剂量为200～333mg或150～250mg（B对）。